既补肾助阳，又润肠通便的药是
A. 锁阳
B. 狗脊
C. 杜仲
D. 紫河车
E. 冬虫夏草

正确答案：A。锁阳

解析：本题考查锁阳的功效。既补肾助阳，又润肠通便的药是锁阳（A对）。锁阳【功效】补肾阳，益精血，润肠通便。狗脊（B错）【功效】补肝肾，强腰膝，祛风湿。杜仲（C错）【功效】补肝肾，强筋骨，安胎。紫河车（D错）【功效】温肾补精，养血益气。冬虫夏草（E错）【功效】益肾补肺，止血化痰。